针对误食毒物，为时不久，毒物尚在胃脘的实证，应采用的治法
A. 清法
B. 吐法
C. 温法
D. 下法
E. 消法

正确答案：B。吐法

解析：本题考查的是治法。针对误食毒物，为时不久，毒物尚在胃脘的实证，应采用的治法吐法（B对）。吐法：又称“涌吐法”，是针对停蓄在咽喉、胸膈、胃脘的痰涎、宿食、毒物而拟定的治法。适用于中风、癫狂、喉痹之痰涎壅盛、阻塞咽喉；或宿食停滞胃脘；或误食毒物，为时不久，毒物尚留胃中者等。吐法根据体质强弱、病情轻重等情况，可分为峻吐法、缓吐法等。清法（A错）：又称“清热法”，是运用寒凉性质的方药，通过其泻火、解毒、凉血等作用，以解除热邪的治法。清法适用于里热证。由于热邪有虚实、病位及间夹他邪的不同，清热法又分为清热泻火法、清热凉血法、清热燥湿法、清热解毒法、清虚热法等。温法（C错）：又称“温里法”，是使用温热药治疗寒证的治法。温里法适用于里寒证。由于里寒证病情的不同，温里法又分为温中祛寒法、回阳救逆法、温经散寒法三种。下法（D错）：又称“泻下法”，是运用具有泻下作用的药物，通泻大便，逐邪外出的治疗方法。下法适用于胃肠实热内结或寒积、宿食积滞、水饮、痰湿、瘀血等停留体内的里实证。下法针对里实证病机有热结、寒结、燥结和水结等的不同，以及体质有虚实的差异，可分为寒下法、温下法、润下法、泻下逐水法、攻补兼施法五种。消法（E错）：又称“消导法”，是消散体内有形积滞以祛除病邪的治法。运用范围比较广泛，凡由气、血、痰、湿、食等壅滞而形成的积滞痞块，均可用消法。由于致病原因和病情的不同，消法主要分为消食导滞、消痞散积、软坚散结等。